脑膜炎球菌是
A. 葡萄球菌属
B. 奈瑟菌属
C. 链球菌属
D. 念珠球菌属
E. 隐球菌属

正确答案：B。奈瑟菌属

解析：脑膜炎奈瑟菌（又称脑膜炎球菌）属奈瑟菌属（B对），革兰染色阴性，呈肾形双球菌，0.6～0.8μm大小。有荚膜，无芽胞，不活动。为专性需氧菌，在普通培养基上不易生长，在巧克力或血培养基或卵黄培养基上生长良好。